下列部门的主要职责，配合相关部门加强互联网药品广告管理，负责依法查处虚假、违法违规药品广告信息网站的部门是
A. 市场监督管理部门
B. 商务部门
C. 公安部门
D. 互联网信息管理部门

正确答案：D。互联网信息管理部门

解析：本题考查互联网信息管理部门。互联网信息管理部门（D对）配合相关部门进一步加强互联网药品广告管理，大力整治网上虚假违法违规信息，依法查处发布虚假违法广告信息等的违法违规网站，营造风清气正的网络空间。市场监督管理部门（A错）负责相关市场主体登记注册和营业执照核发，查处准人、生产、经营、交易中的有关违法行为，实施反垄断执法、价格监督检查和反不正当竞争，负责药品、保健食品、医疗器械、特殊医学用途配方食品广告审查和监督处罚。商务部门（B错）负责拟订药品流通发展规划和政策，药品监督管理部门在药品监督管理工作中，配合执行药品流通发展规划和政策。公安部门（C错）负责组织指导药品、医疗器械和化妆品犯罪案件侦查工作。